发表透疹宜生用，止血须炒炭的药是
A. 薄荷
B. 西河柳
C. 荆芥
D. 苍耳子
E. 牛蒡子

正确答案：C。荆芥

解析：本题考查的是荆芥的用法用量。发表透疹宜生用，止血须炒炭的药是荆芥（C对）。荆芥：【用法用量】内服：煎汤，3～10g，不宜久煎；或入丸散。外用：适量，煎水熏洗，捣烂外敷或研末调敷。荆芥穗发汗力强。发表、透疹、消疮宜生用；止血须炒炭用。薄荷（A错）：【用法用量】内服：煎汤，2～10g；或入丸散；不宜久煎，入汤剂当后下。外用：适量，鲜品捣敷或捣汁涂，也可煎汤洗或含漱。其叶长于发汗，梗偏于理气。西河柳（B错）：【用法用量】内服：煎汤，3～10g。外用：适量，煎汤擦洗。苍耳子（D错）：【用法用量】内服：煎汤，3～10g；或入丸散。外用：适量，捣敷，或煎汤洗。牛蒡子（E错）：【用法用量】内服：煎汤，3～10g；或入丸散。入煎剂宜打碎，炒用寒性略减。